长期应用广谱抗生素造成二重感染的不良反应属于
A. 特异质反应
B. 停药反应
C. 后遗效应
D. 毒性反应
E. 继发反应

正确答案：E。继发反应

解析：本题考查继发反应的定义。继发反应（E对）是继发于药物治疗作用之后的不良反应，是治疗剂量下治疗作用本身带来的间接结果。例如，长期应用广谱抗生素，使敏感细菌被杀灭，造成二重感染。